治疗虚寒痢，应首选
A. 白头翁汤
B. 芍药汤
C. 真人养脏汤
D. 胃苓汤
E. 连理汤

正确答案：C。真人养脏汤

解析：虚寒痢，治宜温补脾肾，收涩固脱，真人养脏汤涩肠固脱，温补脾肾，为首选（C对）。白头翁汤（A错）可以清热解毒，凉血止痢，治疗热毒痢疾。芍药汤（B错）功效为清热燥湿，调气和血，治疗湿热痢疾。胃苓汤（D错）可以祛湿和胃，行气利水，治疗水湿内停气滞证。连理汤（E错）功效为温中祛寒，兼清郁热，治疗脾胃虚寒，腹痛泄泻，呕吐酸水，苔白舌边红者。